女，45岁。脸圆、变红1年，体重增加、月经稀发6个月。查体：BP160/100mmHg，向心性肥胖，皮肤薄，面部痤疮较多，下颌小胡须，全身毳毛增多，腹部、大腿根部可见宽大紫纹。血钾3.3mmol/L，空腹血糖15.4mmol/L。定性诊断最主要的检查是
A. 大剂量地塞米松试验
B. 血ACTH测定
C. 小剂量地塞米松试验
D. 血皮质醇测定
E. 血醛固酮测定

正确答案：C。小剂量地塞米松试验

解析：患者脸圆变红，皮肤薄有痤疮，月经稀发，下颌小胡须，全身毳毛增多（女性患者由于肾上腺雄激素产生过多以及皮质醇对垂体促性腺激素的抑制作用，可出现月经减少、不规则或停经，痤疮常见，可见男性化表现），血压偏高，向心性肥胖，腹部、大腿根部见宽大紫纹，低血钾（正常值3.5～5.5mmol/L），高血糖（大于7.0mmol/L）等表现均提示库欣综合征。库欣综合征血浆皮质醇分泌增多，失去昼夜节律，且不能被小剂量地塞米松抑制（P700）。地塞米松为人工合成的糖皮质激素中生物作用最强的激素之一，仅需要很小的剂量即能达到与天然皮质醇相似的作用，使用小剂量地塞米松可抑制正常人的皮质醇分泌，从而血皮质醇测定值减少，而库欣综合征却不受影响。因此小剂量地塞米松抑制试验（C对）可以用于库欣综合征的定性诊断。大剂量地塞米松试验（A错）主要用于库欣综合征确诊后不同病因之间的鉴别诊断。血ACTH测定（B错）主要用于鉴别依赖ACTH的库欣综合征与不依赖ACTH的库欣综合征。血皮质醇（D错）增高无特异性，肥胖症患者亦可增高。血醛固酮测定（E错）主要用于醛固酮增多症的诊断。